是由现在开始追访未来，其目的是预见的研究
A. 纵向研究
B. 后瞻研究
C. 前瞻研究
D. 横断研究
E. 回顾研究

正确答案：C。前瞻研究

解析：前瞻研究：由现在开始追访未来，其目的是预见。该种研究操作性较强，花费较大。由于科学真理的核心是可重复的预见，该研究得到的结果比较肯定，很少有人为的因素，因此前瞻研究是很有价值和很有意义的研究。掌握“医学心理学研究方法及其应用”知识点。